医生的权利是
A. 具有独立作出诊断和治疗的权利以及特殊干涉权
B. 对病人义务和对社会义务的统一
C. 绝对干涉权
D. 保持和恢复健康，积极配合医疗，支持医学科学研究
E. 支持医学科学研究

正确答案：A。具有独立作出诊断和治疗的权利以及特殊干涉权